以下哪项药物为一种人工合成的鸟苷类衍生物广谱抗病毒药
A. 肾上腺素
B. 甲硝唑
C. 氟康唑
D. 红霉素
E. 利巴韦林

正确答案：E。利巴韦林

解析：利巴韦林是一种人工合成的鸟苷类衍生物，为广谱抗病毒药，对多种RNA和DNA病毒有效。掌握“氟康唑、利巴韦林及阿昔洛韦”知识点。